残疾儿童口腔清洁的体位姿势描述正确的是
A. 患儿坐在椅子上，帮助者站在其身后
B. 让残疾儿童躺在帮助者的腿上
C. 让残疾儿童头部躺在帮助者的肘部
D. 帮助者坐于椅上，残疾儿童背靠帮助者坐于地上
E. 以上均可操作

正确答案：E。以上均可操作

解析：本题考查残疾人口腔保健。帮助残疾儿童刷牙，应根据具体情况，选择容易操作的舒适体位和姿势：让患儿坐在椅子上，帮助者站在其身后（A对）；让残疾儿童躺在帮助者的腿上进行操作（B对）；让其头部躺在帮助者的肘部（C对）；帮助者也可坐在矮椅子上，残疾儿童坐在地板上（D对），让其背部靠着帮助者，用膝盖支持其头部和肩部，然后开始操作。因此，选E。